流行性出血热的主要传染源
A. 山羊
B. 狗
C. 人
D. 鼠和猪
E. 鼠

正确答案：E。鼠

解析：本题考查流行性出血热的主要传染源。流行性出血热主要是由带有流行性出血热病毒或汉坦病毒鼠（E对ABCD错）类,经血液或尿液粪便等进行空气传播或接触传播。